师生之间开展多种形式的交流活动，增进融洽，属于学校社会环境的
A. 人际环境
B. 物质环境
C. 社区环境
D. 事物环境
E. 教育环境

正确答案：A。人际环境